属于内分泌组织的是
A. 松果体
B. 睾丸
C. 甲状腺
D. 胰岛
E. 脾

正确答案：D。胰岛

解析：甲状腺（C错）、松果体（A错）属于内分泌腺，以细胞团分散于机体的器官或组织内，如胰内的胰岛（D对）、睾丸（B错）内的间质细胞、卵巢内的卵泡和黄体等属于内分泌组织。而脾（E错）是人体最大的淋巴器官，具有储血、造血、清除衰老红细胞和进行免疫应答的功能。